沉淀蛋白质的方法除外的是
A. 盐析
B. 重金属盐沉淀蛋白质
C. 生物碱试剂与某些酸沉淀蛋白质
D. 有机溶剂沉淀蛋白质
E. 水析

正确答案：E。水析

解析：本题考查蛋白质理化性质。水析（E错，为本题正确答案）不是沉淀蛋白质的方法。蛋白质从溶液中析出的现象称为沉淀。沉淀蛋白质的方法主要有盐析（A对）、重金属离子沉淀（B对）、生物碱试剂沉淀（C对）、有机溶剂沉淀（D对）等。